有关麻醉药品和精神药品储存、保管的正确描述有
A. 麻醉药品和精神药品必须严格实行专库（专柜）保管
B. 麻醉药品和一类精神药品可以存放在同一专用库房（柜）内
C. 麻醉药品必须执行双人、双锁保管制度
D. 应建立麻醉药品的专用账册、专人登记
E. 仓库内须有安全措施，如报警器、监控器

正确答案：A、B、C、D、E。麻醉药品和精神药品必须严格实行专库（专柜）保管；麻醉药品和一类精神药品可以存放在同一专用库房（柜）内；麻醉药品必须执行双人、双锁保管制度；应建立麻醉药品的专用账册、专人登记；仓库内须有安全措施，如报警器、监控器

解析：本题考查药品的贮存。麻醉药品和第一类精神药品的储存保管必须严格执行专库（专柜）保管（A对），二者可存放在同一专用库（柜）房内（B对）。专库（柜）必须执行双人双锁保管（C对）制度，仓库内须有安全措施，如警报器、监控器（E对）。按照药品的性质来决定储藏条件。麻醉药品大部分品种遇光易变质，应注意避光，采取遮光措施。应建立麻醉药品、精神药品的专用账目，专人登记（D对），定期盘点，做到账物相符。发现问题，立即报告当地药品监督管理部。